人参皂苷Rbl属于
A. 螺旋甾烷醇型皂苷
B. 达玛烷型皂苷
C. 齐墩果烷型皂苷
D. 乌索烷型皂苷
E. 羽扇豆烷型皂苷

正确答案：B。达玛烷型皂苷